胫骨中下1/3处骨折易发生延迟愈合的原因是
A. 骨形态转变处
B. 骨皮质薄，强度差
C. 骨营养动脉损伤
D. 前内侧位于皮下有棱角
E. 骨干下1/3处肌肉丰富

正确答案：C。骨营养动脉损伤

解析：胫骨的营养血管从胫骨干上、中1/3交界处进入骨内，故中、下1/3的骨折易使营养动脉损伤，使得供应下1/3段胫骨的血液循环显著减少。骨折部位的血液供应是影响骨折愈合的重要因素，故胫骨中下1/3骨折易发生延迟愈合的原因是骨营养动脉损伤（C对）骨形态转变处（A错）是胫骨干中、下1/3处好发骨折的原因。胫骨骨皮质厚，强度较大（B错），骨干下1/3处几乎无肌肉附着（E错）。前内侧位于皮下有棱角（D错）是胫骨骨折端极易穿破皮肤而形成开放性骨折的原因。